男性，30岁，农民。既往体健。7月2日来诊，腹泻2天，为水样便带少量粘液，量多，日十余次，相继呕吐数次。无发热、无腹痛。腓肠肌痉挛。体检：体温36.8℃，神志清，皮肤弹性差，脉细速，血压70/30mmHg。化验检查：大便镜检白细胞0～2/HP，血红蛋白160g/L，血白细胞计数12×10⁹/L，中性粒细胞0.78，淋巴细胞0.12，单核细胞0.10。本例治疗的关键环节是
A. 抗菌治疗
B. 抗病毒治疗
C. 补充液体和电解质
D. 低分子右旋糖酐扩容
E. 首选升压药，纠正低血压

正确答案：C。补充液体和电解质

解析：30岁男性患者，7月份发病（霍乱流行季节），腹泻2天，为水样便带少量粘液，量多，日十余次，相继呕吐数次，无发热无腹痛（霍乱泻吐期典型表现）；腓肠肌痉挛（脱水期肌肉痉挛表现）；查体体温36.8℃，神志清，皮肤弹性差，脉细速，血压70/30mmHg（有脱水症状）；化验检查：大便镜检白细胞0～2/HP，血红蛋白160g/L（成年男性血红蛋白正常参考值120～160g/L），血白细胞计数12×10⁹/L（4～10×10⁹/L），中性粒细胞0.78（0.5～0.7），淋巴细胞0.12（正常值0.2～0.4），单核细胞0.10，根据患者的临床表现和实验室数据，最可能的诊断是霍乱，其治疗原则是：严格隔离，及时补液，辅以抗菌和对症治疗，其中，补充液体和电解质的补液疗法是本例治疗的关键环节（C对）。抗菌治疗作为液体疗法的辅助治疗（A错）。霍乱不是病毒感染引起的，无需抗病毒治疗（B错）。本病的补液治疗一般多采用与患者丢失的电解质溶液相近的541液，一般不采用低分子右旋糖酐（D错）。本病低血压的原因是血容量不足，因此应首先补足血容量，而不是首选升压药（E错）。